产程中胎心监护，下列哪项是错误的
A. 听胎心应在宫缩间歇期，宫缩刚结束时进行
B. 潜伏期应每小时听胎心1次
C. 活跃期每30分钟听胎心1次
D. 第二产程应每15分钟听胎心1次
E. 每次胎心听诊应听1分钟

正确答案：D。第二产程应每15分钟听胎心1次